男性，35岁。因全口牙自幼呈黄色，后似有加重为黄褐色，要求治疗。查见全口牙均为黄褐色，表面光滑无缺损。医师应做的重点询问是
A. 牙病治疗史
B. 幼时患病史
C. 母亲患病史
D. 幼时居住地
E. 幼时患病用药史

正确答案：E。幼时患病用药史

解析：本题考查四环素牙的诊断。患者男性，因全口牙自幼呈黄色（初始色），后似有加重为黄褐色（后变色），要求治疗。查见全口牙均为黄褐色，表面光滑无缺损（四环素牙）。综合考虑为四环素牙。医师应做的重点询问是幼时患病用药史（E对）。四环素在牙本质内，因结合部位的深浅而使牙本质着色的程度有所不同，当着色带越靠近釉牙本质界时，越易着色。因而在婴幼儿早期，形成外层牙本质时，用药影响最大。由于患者临床表现不符合氟斑牙的症状，故不应重点询问幼时居住地（D错）。牙病治疗史（A错）、幼时患病史（B错）、母亲患病史（C错）均为干扰选项，应重点询问幼时患病用药史。